以下药物的鉴别反应为：维生素E
A. 供试品在碱性条件下水解后，用乙醚萃取，分取乙醚液，加2，2-联吡啶溶液和三氯化铁溶液，显血红色
B. 取供试品的氯仿溶液，加25％的三氯化锑氯仿溶液，即显蓝色，渐变为紫红色
C. 显氯化物的鉴别反应
D. 显钠盐的鉴别反应
E. 取供试品溶液，加二氯靛酚钠试液，试液的红色即消失

正确答案：A。供试品在碱性条件下水解后，用乙醚萃取，分取乙醚液，加2，2-联吡啶溶液和三氯化铁溶液，显血红色